全冠永久黏固后松动脱落，其主要原因，除了
A. 预备体轴壁聚合角过大
B. 咬合侧向力过大
C. 修复体不密合
D. 牙周病
E. 粘固失败

正确答案：D。牙周病

解析：本题考查修复体试戴、磨光与粘固。牙周病（D错，为本题正确答案）不是全冠永久黏固后松动脱落的主要原因。修复体松动、脱落原因①修复体固位不足，如轴壁聚合度过大（A对），（牙合）龈距太短，修复体不密合（C对），桩过短，固位型不良。②咬合创伤、（牙合）力过大，（牙合）力集中，侧向力过大（B对）。③粘固失败（E对）。如粘固时材料选用不当，粘固剂失效，牙面及修复体粘固面未清洗干净，干燥不彻底，油剂、唾液污染，粘固剂尚未完全结固时，患者咀嚼破坏了结固等。